下列有关颞间隙的解剖结构特点的叙述中，正确的是
A. 颞深筋膜致密
B. 颞窝骨质以颞鳞处最薄
C. 颞肌坚厚
D. 颞部脓肿形成后，难以自行穿破
E. 以上均正确

正确答案：E。以上均正确

解析：颞间隙的解剖结构特点：①颞深筋膜致密；②颞肌坚厚；③颞窝骨质以颞鳞处最薄，其内、外骨板间板障很少。因此，颞部脓肿形成后，难以自行穿破，脓液过久积存于颞鳞表面，压迫骨皮质，使其坏死，发生骨髓炎，感染由此可直接向颅内或通过邻近脑膜的血管蔓延，导致脑膜炎、脑脓肿等并发症。掌握“面侧深区及颌面部各间隙的境界”知识点。